穿心莲中主要化学成分的结构类型是
A. 大环内酯
B. 甲型强心苷内酯
C. 乙型强心苷内酯
D. 二萜内酯
E. 香豆素内酯

正确答案：D。二萜内酯

解析：本题考查的是穿心莲的主要化学成分及其结构。穿心莲中主要化学成分的结构类型是二萜内酯（D对）。穿心莲叶中含有多种二萜内酯及二萜内酯苷类成分，如穿心莲内酯、新穿心莲内酯、14-去氧穿心莲内酯、脱水穿心莲内酯等。其中穿心莲内酯含量最高，为其主要活性成分。《中国药典》以穿心莲内酯、新穿心莲内酯、14-去氧穿心莲内酯、脱水穿心莲内酯为指标成分进行含量测定，要求其总量不得少于1.5%。